肱骨内上髁骨折，最有可能损伤的神经是
A. 尺神经
B. 胸背神经
C. 腋神经
D. 肌皮神经
E. 无

正确答案：A。尺神经

解析：尺神经（A对）容易受到损伤的部位包括肘部肱骨内上髁后方、尺侧腕屈肌起点处和豌豆骨外侧。肱骨外科颈骨折、肩关节脱位和使用腋杖不当所致的重压，都有可能造成腋神经（C错）的损伤。肱骨骨折和肩关节损伤时可合并肌皮神经（D错）的损伤。